干槽症的特征性表现是
A. 开口受限
B. 冷热痛
C. 术后l～3天放射性疼痛
D. 术后3～5天肿痛未开始消退
E. 拔牙创内无血凝块

正确答案：E。拔牙创内无血凝块

解析：本题考查干槽症的特征性表现。拔牙窝内空虚，拔牙创内无血凝块（E对），有时拔牙窝内有腐败坏死物质，但非正常血凝块，骨面暴露、牙槽骨壁有触痛。干槽症是在拔牙后2～3天出现剧烈疼痛，会向是耳颞部、下颌区或头颈部放射，若不经治疗，可持续达10余天，不是术后l～3天出现（C错），也不是冷热痛（B错）或肿痛（D错）。干槽症一般不出现开口受限（A错）。